对眼睛具有最强烈催泪作用的光化学烟雾剂是
A. O₃
B. PAN
C. PBN
D. PPN
E. NO

正确答案：C。PBN

解析：本题考查对眼睛具有最强烈催泪作用的光化学烟雾剂。PBN（C对ABDE错）是一种有效的光化学烟雾剂，具有较强的挥发性，可以在空气中快速挥发，引起眼睛的强烈刺激，从而产生催泪作用。